对确保风险评估结果的科学客观具有重要意义的是
A. 风险评估与风险交流的相对独立
B. 风险管理与风险交流的相对独立
C. 风险评估与风险管理的相互融合
D. 风险评估与风险管理的相对独立
E. 风险评估与风险交流的相互融合

正确答案：D。风险评估与风险管理的相对独立